下述关于软腭的叙述中哪项是错误的
A. 粘膜下层中所含粘液腺较少
B. 腭腱膜位于软腭前1/3，构成软腭的支架
C. 腭肌位于软腭的后2/3，肌肉细小
D. 腭腱膜近硬腭部分坚厚，向后则变薄弱
E. 腭裂者软腭肌肉的起始正常，但附着点异常

正确答案：A。粘膜下层中所含粘液腺较少

解析：软腭黏膜下层：黏膜下层中含有较多的黏液腺。黏膜下层在腭垂、腭舌弓及腭咽弓处特别疏松。腭腱膜及腭肌：位于黏膜下层深面。腭腱膜位于软腭前1/3，构成软腭的支架，镶嵌附丽于硬腭后缘，它主要由腭帆张肌的腱膜组成，其他腭肌也附丽其上。腭腱膜近硬腭部分非常坚厚，向后则变薄弱，软腭为之所衬托的部分呈水平状。腭肌位于软腭的后2/3，前续腭腱膜，共5对，它们是腭帆张肌、腭帆提肌、腭舌肌、腭咽肌和腭垂肌。掌握“腭、舌、舌下区的局部解剖”知识点。